由于老年人的靶器官或细胞的敏感性增强，尤其是对中枢神经抑制药物、降血糖药物、心血管系统药物反应特别敏感，在正常剂量下的不良反应增加，甚至出现药源性疾病，因此在联合用药中应高度重视。患有心脑血管疾病的老年糖尿病患者使用二甲双胍降糖时，应避免联用
A. 消栓胶嚢
B. 麝香保心丸
C. 逐瘀通脉胶囊
D. 银杏叶片
E. 培元通脑胶囊

正确答案：E。培元通脑胶囊

解析：本题考查的是老年人合理应用中药的原则。患有心脑血管疾病的老年糖尿病患者使用二甲双胍降糖时，应避免联用培元通脑胶囊（E对）。老年人合理应用中药时，应熟悉药品，恰当选择应用：由于老年人的靶器官或细胞的敏感性增强，使他们对药物的反应比年轻人强烈，特别是对中枢神经抑制药物、降血糖药物、心血管系统药物反应特别敏感，在正常剂量下的不良反应增加，甚至出现药源性疾病，因此在联合用药中应高度重视。如麝香保心丸（B错）与地高辛等强心类药物联合用药，由于麝香保心丸中所含蟾酥的基本化学结构与强心苷相似，在化学结构上有相似之处，故具有与强心苷类药物地高辛相似的强心作用，联合应用势必会造成相同或相似功效的累加，产生拟似效应，诱发强心苷中毒，出现频发性早搏等心律失常等不良反应。常有一些患有胃病的老年患者将银杏叶及其提取物制剂和法莫替丁片同时服用。法莫替丁片为抗溃疡抗酸药，与含有多量黄酮类成分的银杏叶制剂同时服用可产生络合效应，形成螯合物，影响疗效。因此，在服用抗酸类西药时应避免与含黄酮类的中药如复方丹参片、复方丹参滴丸、银杏叶片（D错）等同服，应分时应用，一般来讲，以间隔1小时为宜。患有糖尿病的心脑血管患者用培元通脑胶囊、益心通脉颗粒、活血通脉片等含有甘草、人参、鹿茸等成分的中成药，可使降糖药的疗效降低。因为，甘草、人参、鹿茸具有糖皮质激素样作用，可以促进糖原异生，升高血糖，与降糖药二甲双胍、消渴丸、阿卡波糖和胰岛素产生拮抗作用，导致降糖效果降低。因此，要尽量准确了解老年患者的用药情况，对此类患者尽量选用不含此类成分的中成药。如必须并用，应适当加大降糖药的剂量，并密切注意患者的血糖变化，避免加重患者的病情。此外，含有糖皮质激素样物质的中药甘草、鹿茸应避免与阿司匹林合用，防止加重对胃黏膜的损伤。老年人使用消栓胶囊（A错）与逐瘀通脉胶囊（C错）的注意事项，2022年考试指南未明确说明。消栓胶囊：【注意事项】孕妇忌服。中风急性期痰热证、风火上扰证者不宜使用。阴虚阳亢证、肝阳上亢证及有出血倾向者慎用。服药期间，饮食宜清淡，忌辛辣食物。病情急重者宜结合相应抢救治疗措施。逐瘀通脉胶囊：【注意事项】脑出血患者禁用。孕妇、体虚者、肝肾功能不全者忌用。脑梗死急性期应与一般综合治疗结合使用。